李某是一糖尿病患者，甲医疗机构为其开具治疗糖尿病的药品处方，乙医疗机构是该处方药品的调剂机构，此时处方应由谁妥善保存
A. 甲医疗机构
B. 乙医疗机构
C. 患者本人
D. 患者本人或者其近亲属
E. 甲乙医疗机构共同保管

正确答案：B。乙医疗机构

解析：根据《处方管理办法》第五十条规定，处方由调剂处方药品的医疗机构妥善保存。题干中乙医疗机构是处方药品的调剂机构，因而应由乙医疗机构妥善保存处方（B对）。